关于妊娠期母体乳房的变化，正确的是
A. 妊娠晚期开始乳汁分泌
B. 大量雌激素刺激乳腺腺泡发育
C. 大量孕激素刺激乳腺腺管发育
D. 初乳为白色浓稠液体
E. 乳头增大变黑、乳晕颜色加深

正确答案：E。乳头增大变黑、乳晕颜色加深

解析：妊娠期间胎盘分泌大量雌、孕激素使乳腺充分发育，雌激素可刺激乳腺腺管发育（B错），孕激素可刺激乳腺腺泡发育（C错），乳头增大变黑、乳晕颜色加深（E对）。但是大量的雌孕激素抑制了乳汁的生成，妊娠晚期无乳汁分泌现象（A错）。初乳是妊娠末期，尤其在接近分娩期，挤压乳房时出现的少量淡黄色稀薄液体（D错）。